依照《城镇职工基本医疗保险用药范围管理暂行办法》，基本医疗保险药品目录中的“乙类目录”是指
A. 从国家基本药物中遴选出来，在全国范围内使用的药品
B. 从国家基本药物中遴选出来，在省市范围内使用的药品
C. 临床必需、安全有效、价格合理、使用方便、市场能够保证供应的药品
D. 临床治疗必需，使用广泛，疗效好，同类药品中价格低的药品
E. 可供临床治疗选择使用，疗效好，同类药品中价格略高的药品

正确答案：E。可供临床治疗选择使用，疗效好，同类药品中价格略高的药品

解析：本题考查的是医保药品目录分类。依照《城镇职工基本医疗保险用药范围管理暂行办法》，基本医疗保险药品目录中的“乙类目录”是指可供临床治疗选择使用，疗效好，同类药品中价格略高的药品（E对）。医保药品目录分类：医保药品目录分“甲类目录”和“乙类目录”。“甲类目录”的药品是临床治疗必需，使用广泛，疗效好，同类药品中价格低的药品（D错）。“乙类目录”的药品是可供临床治疗选择使用，疗效好，同类药品中比“甲类目录”药品价格略高的药品。医保目录调入分为常规准入和谈判准入两种方式。在满足有效性、安全性等前提下，价格（费用）与药品目录内现有品种相当或较低的，可以通过常规方式纳入目录；价格较高或对医保基金影响较大的专利独家药品应当通过谈判方式准入。《国家基本医疗保险、工伤保险和生育保险药品目录》列入品种为常规准入药品。目录共分为凡例、西药、中成药、协议期内谈判药品、中药饮片五部分。西药部分包括了化学药品和生物制品；中成药部分包含了中成药和民族药；协议期内谈判药品部分包括了尚处于谈判协议有效期内的药品。西药、中成药和协议期内谈判药品分甲乙类管理，协议期内谈判药品按照乙类支付。医保药品目录中列出了基本医疗保险、工伤保险和生育保险基金准予支付的中药饮片，同时列出了不得纳入基金支付的饮片范围。同时，目录包括限工伤保险基金准予支付费用的品种、限生育保险基金准予支付费用的品种。工伤保险和生育保险支付药品费用时不区分甲、乙类。